寒邪袭表的寒热特点是
A. 恶寒重，发热轻
B. 发热重，恶寒轻
C. 发热轻，恶风
D. 寒热往来
E. 畏寒肢冷

正确答案：A。恶寒重，发热轻

解析：寒为阴邪，其性收引，寒邪袭表，束表伤阳，肌腠闭塞，卫阳郁闭于内，肌表失于温煦，故恶寒明显而发热轻（A对）。发热重恶寒轻由外感风热之邪所致，是风热表证的特征（B错）。发热轻而恶风由外感风邪所致，是伤风表证的特征（C错）。恶寒热往来是正邪相争，互为进退的病理反映，常见于伤寒病的少阳病证，为邪在半表半里证的特征（D错）。畏寒肢冷见于久病畏寒主要见于里虚寒证，多因阳气虚衰，形体失于温煦所致（E错）。